上消化道出血属于中医何病的范畴
A. 吐血、便血
B. 尿血、呕血
C. 咳血、吐血
D. 便血、尿血
E. 咳血、尿血

正确答案：A。吐血、便血

解析：上消化道出血是指Treitz韧带以上的消化道包括食道、胃、十二指肠、胆、胰等病变引起的出血，常表现呕血和（或）黑便（即便血），故属于中医吐血、便血病的范畴（A对）。